股动脉
A. 是髂内动脉的直接延续
B. 续于髂外动脉
C. 外侧有股静脉伴行
D. 在收肌管中发出股深动脉
E. 无

正确答案：B。续于髂外动脉

解析：股动脉是髂外动脉（B对）的直接延续（A错）。穿过收肌管后发出腘动脉（D错）。